人传播人模式的流行曲线特点是
A. 快速上升，快速下降
B. 开始阶段病例数较多，然后病例缓慢降低
C. 快速上升，缓慢下降
D. 开始阶段病例数较少，然后病例缓慢增加
E. 发病高峰过后，曲线缓慢下降

正确答案：D。开始阶段病例数较少，然后病例缓慢增加

解析：本题考查人传播人模式的流行曲线特点。由图中可看出发病时间为12天之前发病人数较少，从12天之后开始缓慢增多，第15天发病人数最多，之后逐渐减少（D对ABCE错）。